以水为溶剂可选择的方法为
A. 非水碱量法
B. 非水酸量法
C. 两者均可
D. 两者均不可

正确答案：D。两者均不可

解析：本题考查非水溶液滴定法。以水为溶剂可选择的方法为两者均不可（D对）。非水溶液滴定法是在非水溶剂中进行滴定的容量分析方法。以非水溶液为滴定介质，能改变物质的化学性质（主要是酸碱强度），使在水中不能反应完全的滴定反应能在非水溶液中顺利进行，有时还能增大有机化合物的溶解度。非水碱量法（A错）和非水酸量法（B错）均为非水溶液滴定法，故两者均不能以水为溶剂（C错）。